病毒性心肌炎湿热邪毒内侵心脉证的用方是
A. 银翘散
B. 附子汤
C. 葛根芩连汤
D. 生脉散合复脉汤
E. 血府逐瘀汤合生脉散

正确答案：C。葛根芩连汤

解析：病毒性心肌炎湿热邪毒内侵心脉证是由于湿热邪毒蕴于肠胃，由表入里，留而不去，内舍于心，心脉痹阻所致，治疗时应清热化湿，宁心安神，首选葛根黄芩黄连汤（C对）。银翘散（A错）其功用为辛凉透表，清热解毒，适用于病毒性心肌炎之风热犯心证。附子汤（B错）其功用为温经助阳，祛寒化湿，适用于肾阳虚衰兼水湿泛滥之证。生脉散合复脉汤（D错），生脉散的功用为益气生津，敛阴止汗，复脉汤的功用为益气滋阴，通阳复脉，二者合用，适用于病毒性心肌炎之气阴亏虚证。血府逐瘀汤合生脉散（E错），血府逐瘀汤的功用为活血化瘀，行气止痛，生脉散的功用为益气生津，敛阴止汗，二者合用，适用于病毒性心肌炎之气虚血滞证。